有关颌裂说法错误的是
A. 颌裂仅发生于上颌
B. 常伴有唇裂或腭裂
C. 下颌裂罕见
D. 上颌裂为前腭突与上颌突未能联合
E. 上颌裂为前腭突与上颌突部分联合

正确答案：A。颌裂仅发生于上颌

解析：颌裂：颌裂可发生于上颌，也可发生于下颌，但上颌裂常见。上颌裂为前腭突与上颌突未能联合或部分联合所致，常伴有唇裂或腭裂。下颌裂为两侧下颌突未联合或部分联合的结果，罕见。掌握“腭部与舌的发育”知识点。